下列哪种因素能够加速氧化磷酸化
A. ATP/ADP下降
B. 解偶联剂的作用
C. 甲状腺激素分泌减少
D. 线粒体DNA突变
E. CO生成增多

正确答案：A。ATP/ADP下降

解析：能够影响NADH、FAD的产生、影响呼吸链组分和ATP合酶功能的因素，都会影响氧化磷酸化进而影响ATP的生成。解偶联剂（B错）可使氧化与磷酸化的偶联分离，电子可沿呼吸链正常传递，但建立的质子电化学梯度被破坏，不能驱动ATP合酶来合成ATP，从而阻断ADP的磷酸化过程。甲状腺激素（C错）促进细胞膜上Na⁺，K⁺-ATP酶的表达，使ATP加速分解为ADP和Pi，ADP浓度增加而促进氧化磷酸化，因此甲状腺激素减少氧化磷酸化下降。线粒体DNA突变（D错）可直接影响电子的传递过程或ADP的磷酸化，使ATP生成减少而致能量代谢紊乱、引起疾病。CO（E错）与还原型Cyta3结合，阻断电子传递给O₂，减慢氧化磷酸化。